脾胃虚寒者需慎用的中成药有
A. 伤风感冒颗粒
B. 风热感冒颗粒
C. 桑菊感冒颗粒
D. 银翘解毒颗粒
E. 三金感冒片

正确答案：B、C、D、E。风热感冒颗粒；桑菊感冒颗粒；银翘解毒颗粒；三金感冒片